从口内取出可摘局部义齿印模时，一般先
A. 取后部，再沿前牙长轴方向取下印模
B. 取前部，再沿前牙长轴方向取下印模
C. 前后翘动，再沿前牙长轴方向取下印模
D. 取缺失区，再沿前牙长轴方向取下印模
E. 取非缺失区，再沿前牙长轴方向取下印模

正确答案：A。取后部，再沿前牙长轴方向取下印模

解析：本题考查从口内取出可摘局部义齿印模。可摘局部义齿印模有两种，一种是解剖式印模，另一种是功能性印模。无论哪一种印模，制取过程中，都要保持稳定不动，否则会造成印模变形。印模由口内取出时，一般要先取后部，因为后部上颌是软腭，下颌是磨牙后垫，均为松软组织，活动度大，这样很容易破坏印模的边缘封闭，使空气进入印模中，因此容易取下印模且不会造成印模变形（A对）。前后翘动取印模易造成印模变形（C错）。取缺失区（D错）或非缺失区（E错）均不易破坏印模的边缘封闭，义齿印模不易取下。